关于微生物叙述不正确的是
A. 广泛存在于自然界
B. 形体微小、数量繁多
C. 肉眼可见
D. 低等生物体
E. 需借助于光学显微镜或电子显微镜放大数百倍、上千倍甚至数万倍才能观察

正确答案：C。肉眼可见